茵陈的功效是
A. 清热利湿，止痛
B. 清热利湿，杀虫
C. 清热利湿，退黄
D. 清热利湿，化痰
E. 清热利湿，解暑

正确答案：C。清热利湿，退黄

解析：本题考查茵陈的功效。茵陈的功效是清热利湿，退黄（C对）。茵陈【功效】清热利湿，退黄。细辛【功效】祛风散寒，通窍，止痛（A错），温肺化饮。苦参【功效】清热燥湿，杀虫（B错）止痒，利尿。丝瓜络【功效】祛风通络，化痰（D错）解毒。佩兰【功效】化湿，解暑（E错）。